下列因素中与药物性牙龈增生有关的是
A. 口腔卫生状况
B. 服药持续时间
C. 用药剂量
D. 年龄
E. 性别

正确答案：A。口腔卫生状况

解析：本题考查与药物性牙龈增生有关的因素。菌斑引起的牙龈炎症可能促进药物性牙龈增生的发生，口腔卫生状况（A对）和药物性牙龈增生的程度有明显关系，菌斑、牙石、食物嵌塞等引起的牙龈炎症能加速和加重药物性牙龈增生的发展。药物性牙龈增生是指长期服用某些药物而引起牙龈的纤维性增生和体积肥大。一般认为牙龈增生的程度和年龄（D错）、性别（E错）、用药剂量（C错）、持续用药的时间（B错）均无关系。